流感病毒最突出的变异是
A. 对不同种属红细胞的凝聚力
B. 对非特异性抑制素的敏感性
C. 抗原变异
D. 对温度的敏感性
E. 病毒的传播力与毒力

正确答案：C。抗原变异

解析：本题考查流感病毒最突出的变异。流感病毒变异有抗原性变异、温度敏感性变异、宿主范围以及对非特异性抑制物敏感性等方面的变异，但最主要的是抗原性变异（C对ABDE错）。抗原性变异与其他病毒不同，特点是表面抗原HA和NA易变异。